蛇咬伤后（神经毒）者，其治法是
A. 活血祛风
B. 清热解毒，凉血止血
C. 清利湿热，凉血熄风
D. 凉血熄风，豁痰开窍
E. 清热解毒，活血祛风，凉血止血

正确答案：A。活血祛风

解析：蛇毒风毒（神经毒）证治法：活血通络，祛风解毒（A对）。清热解毒，凉血止血是火毒（血液毒）证的治法（B错）。